高血压患者不宜选择的食物是
A. 大豆制品
B. 菌藻类食物
C. 水果
D. 水产品
E. 全脂奶油

正确答案：E。全脂奶油

解析：本题考查高血压患者不宜选择的食物。全脂奶油由蛋白质，脂肪，乳酸糖等成分组成，脂肪含量高。高血压患者应减少膳食脂肪摄入量，因此不宜选择全脂奶油（E错，为本题正确答案）。高血压患者可选择一些大豆制品（A对）、菌藻类食物（B对）、水果（C对）、水产品（D对）等。